糖尿病患者，手术后应选用的降血糖药物是
A. 胰岛素
B. 格列苯脲
C. 二甲双胍
D. 阿卡波糖
E. 罗格列酮

正确答案：A。胰岛素

解析：本题考查降血糖药物的适应证。胰岛素是控制高血糖的重要和有效手段，①T1DM;②各种严重的糖尿病急性或慢性并发症;③手术、妊娠和分娩（A对）；④新发 病且与T1DM鉴别困难的消瘦糖尿病患者;⑤新诊断的T2DM伴有明显高血糖;或在糖尿病病程中 无明显诱因出现体重显著下降者;⑥T2DM p细胞功能明显减退者；⑦某些特殊类型糖尿病。